32岁，药物流产后5天，高热伴右下腹痛2天。妇检：白带脓性，宫颈举痛，宫体如妊娠6周，右附件区有明显压痛。本例最可能的诊断是
A. 急性阑尾炎
B. 宫外孕
C. 急性盆腔炎
D. 卵巢巧克力囊肿破裂
E. 以上都不是

正确答案：C。急性盆腔炎

解析：该患者药物流产后，出现高热、右下腹痛，妇检：白带脓性，宫颈举痛，宫体如妊娠6周，右附件区有明显压痛（有盆腔炎高危因素，病情严重者出现高热，白带脓性，宫颈举痛，宫体增大，右附件区有明显压痛），最可能的诊断是急性盆腔炎（C对E错）。急性阑尾炎（A错）的典型体征为转移性右下腹痛；宫外孕（P53）（B错）典型症状为停经后腹痛与阴道流血；卵巢巧克力囊肿破裂（P271）（D错）表现为囊内容物流入盆腹腔引起的突发性剧烈腹痛，伴恶心、呕吐和肛门坠胀，均无脓性白带。